对于急性一氧化碳中毒最有诊断价值的是
A. 血碳氧血红蛋白浓度
B. 血气分析
C. 脑电图检查
D. 心电图检查
E. 头部CT

正确答案：A。血碳氧血红蛋白浓度

解析：诊断标准：血中碳氧血红蛋白（HBCO）呈阳性反应。轻度中毒血液HBCO浓度为10%～30%，中度中毒血液HBCO浓度为30%～40%，重度中毒血液COHB浓度可高达50%（A对）。血气分析可见血氧分压正常，血氧饱和度可正常，血pH降低或正常，血中二氧化碳分压常有代偿性下降，血钾可降低（B错）。急性一氧化碳中毒中有54%～97%的患者可以发现异常脑电图，表现为低波幅慢波增多（C错）。部分患者可出现ST-T改变，也可见到室性期前收缩、传导阻滞或一过性窦性心动过速（D错）。一氧化碳中毒患者于急性期和出现迟发脑病时进行颅脑CT检查见主要异常为双侧大脑皮质下白质及苍白球或内囊出现大致对称的密度减低区，后期可见脑室扩大或脑沟增宽，异常率分别为41.2%和87.5%，脑CT无异常者预后较好，有CT异常者其昏迷时间大都超过48小时（E错）。